据《素问·举痛论》，恐则气
A. 下
B. 结
C. 上
D. 缓
E. 消

正确答案：A。下

解析：恐则气下的意思是恐惧过度则耗伤肾气，使精气下陷不能上升，出现大小便失禁，遗精，滑泄等症状（A对）。思则气结（B错），怒则气上（C错），喜则气缓（D错），悲则气消（E错）。